以净药材提取物制备中药静脉注射剂，要求所测成分在总固体物中的含量至少为
A. 0.9
B. 0.85
C. 0.7
D. 0.25
E. 0.2

正确答案：D。0.25

解析：本题考查注射剂的质量要求。以净药材提取物制备中药静脉注射剂，要求所测成分在总固体物中的含量至少为25%（D对）。中药注射用半成品基本要求：以净药材提取物制备中药静脉注射剂，要求所测成分在总固体物中的含量至少为25%。中药注射用半成品通常包括从中药饮片中提取的有效成分、有效组分。按照《中药天然药物注射剂基本技术要求》等相关规定，以有效成分制成的中药注射剂，其有效成分的纯度应达到90%（A错）以上；以有效组分制备的中药注射剂，在测定其总固体量（mg/ml）基础上，明确成分的含量总和应不低于总固体量的60%。用于配制注射剂前的半成品，应检查重金属、砷盐，检查时样品需进行有机破坏。除另有规定外，含重金属不得过百万分之十，含砷盐不得过百万分之二。以有效部位制备中药注射剂，要求所测有效部位在总固体物中的含量至少为70%（C错）。以净药材提取物制备中药注射剂，要求所测成分在总固体物中的含量至少为20%（E错）。